人工流产后宫颈口粘连的临床表现是
A. 月经失调
B. 周期性腹痛，闭经
C. 基础体温单相
D. 子宫稍大，压痛
E. 带下增多

正确答案：B。周期性腹痛，闭经

解析：人工流产后及即手术流产后宫颈口粘连的临床表现应为周期性腹痛，闭经（B对）。若基础体温无后期升高的体温曲线，提示无排卵（C错）。子宫稍大，压痛临床表现不具有代表性（D错）。